男孩，4岁。生长落后，活动后气促。查体：胸骨左缘第2～3肋间有3/6级收缩期杂音，P₂亢进。X线片示右心房右心室扩大。该患儿最可能的诊断是
A. 房间隔缺损
B. 动脉导管未闭
C. 室间隔缺损
D. 法洛四联症
E. 肺动脉狭窄

正确答案：A。房间隔缺损

解析：患儿，胸骨左缘第2-3肋间有3-6级收缩期杂音，P2亢进，另外X线片示右心房右心室扩大，符合房间隔缺损的特征，应诊断为房间隔缺损（A对）。动脉导管未闭的杂音特征为胸骨左缘第二肋间连续机械样杂音（B错）。室间隔缺损的杂音特征胸骨左缘3-4肋间Ⅲ级收缩期杂音，肺动脉第二音亢进（C错）。法洛四联症的杂音主要源自于其组成之一肺动脉狭窄，杂音特点是胸骨左缘Ⅱ、Ⅲ、Ⅳ肋间收缩期喷射性杂音，不符合所给病例的杂音特点，所以不能诊断为法洛四联症（D错）。肺动脉狭窄胸骨左缘上部有洪亮的Ⅳ/Ⅵ级以上喷射性收缩期杂音，第二心音分裂（而不是肺动脉第二心音亢进）（E错）。